下列哪项不是舍格伦综合征的病理变化
A. 淋巴细胞灶状浸润
B. 病变从小叶中心开始
C. 小叶内腺泡全部消失
D. 小叶内导管的导管上皮增生
E. 小叶轮廓保留

正确答案：A。淋巴细胞灶状浸润

解析：舍格伦综合征主要是淋巴细胞和组织细胞增生浸润。病变从小叶中心开始，起初先沿腺泡之间进行，继而破坏腺泡，使其为密集淋巴细胞取代，有时可形成淋巴滤泡；腺小叶的轮廓仍保留，内无纤维组织的修复反应。小叶内导管可残留，有些导管上皮增生形成上皮岛，或扩张形成囊肿。叶间导管扩张，外形不整，导管上皮部分脱落，管周结缔组织水肿，可有炎症细胞浸润。掌握“坏死性唾液腺化生与舍格伦综合征”知识点。